疫毒痢的治法是
A. 清热解毒化湿
B. 活血解毒和胃
C. 凉血清热利湿
D. 清热利湿和胃
E. 清热凉血解毒

正确答案：E。清热凉血解毒

解析：疫毒痢，临床表现为起病急骤，壮热口渴，头痛烦躁，恶心呕吐，大便频频，痢下鲜紫脓血，腹痛剧烈，后重感特著，甚者神昏惊厥；舌质红绛，舌苔黄燥，脉滑数或微欲绝。本病或因患者体质素虚，或因毒疠过盛，致疫毒深滞肠胃，易入营血；治法宜清热解毒，凉血除积（E对）。方选白头翁汤合芍药汤。